药材总包件数在100件以下的
A. 按1％取样
B. 按3％取样
C. 按5％取样
D. 取样5件
E. 逐件取样

正确答案：D。取样5件